女，50岁。因外伤骨盆骨折急诊入院手术治疗。术后第5天，查体：P100次/分，BP100/60mmHg。实验室检查：Hb75g/L。当日子女两人各献出全血200ml给患者输注。术后第15天，患者出现腹泻，4～6次/日。查体：T39℃，皮肤出现斑丘疹。实验室检查Hb56g/L，WBC2.36×10⁹/L，Plt20×10⁹/L，ALT300U/L，该患者可能发生了
A. 急性溶血反应
B. 输血相关移植物抗宿主病
C. 细菌性反应
D. 严重过敏反应
E. 输血传播艾滋病

正确答案：B。输血相关移植物抗宿主病

解析：患者输血15天后，出现腹泻、发热、皮疹，血红蛋白、白细胞、血小板均降低（成年女性血红蛋白应高于110g/L；白细胞正常值：4～10×10⁹/L；血小板正常值：100～300×10⁹/L）提示骨髓造血受抑制，ALT升高（ALT即谷丙转氨酶，正常值为10～40U/L）提示肝功能受损。综合考虑，患者可能发生了输血相关移植物抗宿主病（P24）（B对）。该病是由于有免疫活性的淋巴细胞输入有严重免疫缺陷的受血者体内，输入的淋巴细胞成为移植物并增殖，对受血者的组织起反应。其临床症状有发热、皮疹、肝炎、腹泻、骨髓抑制和感染等。急性溶血反应（A错）典型症状为输注十几毫升血型不符的血液后即出现寒战、高热、呼吸困难及血红蛋白尿。细菌性反应（C错）轻者仅有发热，重者可在输血后立即出现烦躁、寒战、高热等脓毒血症症状。严重过敏反应（D错）多发生在输血数分钟后，表现为局限性或全身性瘙痒或荨麻疹。输血传播艾滋病（E错）先经历急性感染期、无症状期后才出现明显症状，这一过程常达7～10年。